种植固定桥
A. 可以自行摘戴的固定桥
B. 被称为完全固定桥
C. 固位力主要来自粘接材料的粘结力的固定桥
D. 一端的固定体为固定连接，另一端的固位体为活动连接的固定桥
E. 以各种骨内种植体作为固定桥的支持和固位端制成的固定桥

正确答案：E。以各种骨内种植体作为固定桥的支持和固位端制成的固定桥

解析：种植固定桥：利用植入颌骨内或牙槽窝内的种植体作为固定桥的支持和固位端，然后制作固定桥，修复牙列缺损。掌握“固定桥的组成和分类”知识点。